某蓄电池厂，男工，工龄8年，主诉头昏、头痛、乏力、记忆减退、睡眠障碍、纳差、脐周隐痛，经检验，尿中6-ALA为28.6μmol/L。对病人治疗首选药物是
A. 二巯基丙磺酸钠
B. 补血合剂
C. 依地酸二钠钙
D. 阿托品
E. 葡萄糖酸钙

正确答案：C。依地酸二钠钙

解析：男性患者，有长期接触铅的职业史，出现头昏头痛、乏力、记忆减退、睡眠障碍等神经衰弱表现和纳差伴脐周隐痛等消化系统表现（慢性铅中毒的典型表现），实验室检查尿中ALA增高（慢性铅中毒干扰血红素合成可导致ALA无法转变为卟胆原，血及尿ALA升高），均支持慢性铅中毒。慢性铅中毒首选排铅治疗，依地酸二钠钙（C对）可与铅结合成可溶性金属螯合物促进铅排出体外。二巯基丙磺酸钠（A错）常用于砷、汞、锑中毒的治疗（P881）。阿托品（D错）常用于有机磷农药中毒的治疗（P882）。补血合剂和葡萄糖酸钙不用于铅中毒治疗（BE错）。